中央性颌骨癌好发于
A. 上颌前牙区
B. 上颌磨牙区
C. 下颌磨牙区
D. 下颌前牙区
E. 下颌支

正确答案：C。下颌磨牙区

解析：中央性颌骨癌好发于下颌骨，特别是下颌磨牙区。掌握“中央性颌骨癌及上颌窦癌”知识点。